痄腮腮部肿胀，是由于风温邪毒壅结于
A. 足阳明胃经
B. 足厥阴肝经
C. 足少阳胆经
D. 足太阳膀胱经
E. 手少阳三焦经

正确答案：C。足少阳胆经

解析：足少阳胆经起于眼外角，下行至耳后，外折向上行，经额部至眉上，复返向耳后，本证为风温邪毒，从口鼻而入，壅阻足少阳经脉，与气血相搏，结于腮部而发腮肿（C对）（ABDE错）。